检验医学伦理学理论正确性的唯一标准是
A. 理论全面
B. 理论系统
C. 理论深刻
D. 医学实践
E. 医学科研

正确答案：D。医学实践

解析：医学伦理学的理论产生于医学实践并反作用于医学实践，检验医学伦理学理论正确性的唯一标准是医学实践（D对）。